我国预防非传染性慢性病维生素C的摄入量为
A. 100mg/d
B. 115mg/d
C. 150mg/d
D. 180mg/d
E. 200mg/d

正确答案：E。200mg/d